原位癌是指
A. 异型增生细胞累及全层，侵破基膜
B. 异型细胞累及上皮层的下1/3
C. 上皮细胞异乎常态的增生
D. 异型细胞累及上皮层的下2/3
E. 异型细胞累及上皮全层，未突破基膜

正确答案：E。异型细胞累及上皮全层，未突破基膜

解析：原位癌是指异型细胞累及上皮全层，但未突破基膜（E对）的癌。异型增生细胞累及全层，侵破基膜（A错）的是浸润癌。上皮细胞异乎常态的增生（C错）为非典型增生，异型细胞累及上皮层下1/3（B错）的是轻度非典型增生；异型细胞累及上皮层下2/3（D错）的是中度非典型增生。